组胺可同时作用于组胺H₁和H₂受体产生不同的生理活性，产生该现象的原因
A. 构象异构
B. 几何异构
C. 构型异构
D. 组成差异
E. 代谢差异

正确答案：A。构象异构

解析：本题考查药物立体结构对药物效应的影响。组胺可同时作用于组胺H₁和H₂受体产生不同的生理活性，产生该现象的原因是构象异构（A对）。构象是由分子中单键的旋转而造成的分子内各原子不同的空间排列状态，这种构象异构体的产生并没有破坏化学键，而仅产生分子形状的变化。药物分子构象的变化与生物活性间有着极其重要的关系，这是由于药物与受体间相互作用时，要求其结构和构象产生互补性，这种互补的药物构象称为药效构象。（1）相同的一种结构，因具有不同构象，可作用于不同受体，产生不同性质的活性。（1）相同的一种结构，因具有不同构象，可作用于不同受体，产生不同性质的活性。如组胺，可同时作用于组胺H₁和H₂受体。经对H₁和H₂受体阻断药的研究发现，组胺是以反式构象与H₁受体作用，而以扭曲式构象与H₂受体作用，故产生两种不同的药理作用。（2）只有特异性的优势构象才产生最大活性。如多巴胺，其反式构象是优势构象，而和多巴胺受体结合时也恰好是以该构象作用，故药效构象与优势构象为同一构象，而扭曲式构象由于两个药效基团OH和NH₂间的距离与受体不匹配，故没有活性。几何异构（B错）是由双键或环的刚性或半刚性系统导致分子内旋转受到限制而产生的。构型异构（C错）是原子在大分子中不同空间排列所产生的异构现象。包括顺反异构、对映异构（也称为旋光异构）等。组成差异（D错）、代谢差异（E错）不属于立体结构。